为了较大程度地保留蔬菜、水果中的营养素，下列哪种做法是错误的
A. 先洗后切
B. 先切后洗
C. 现炒现切
D. 急火快炒
E. 现吃现炒

正确答案：B。先切后洗